不能产生肠毒素的细菌是
A. 白喉棒状杆菌
B. 霍乱弧菌
C. 肠产毒性大肠埃希菌
D. 产气荚膜梭菌
E. 金黄色葡萄球菌

正确答案：A。白喉棒状杆菌